主治肺肾阴虚，干咳少痰的中成药是
A. 川贝止咳露
B. 百合固金丸
C. 通宣理肺丸
D. 苏子降气丸
E. 复方四季青片

正确答案：B。百合固金丸

解析：本题考查的是百合固金丸的主治。主治肺肾阴虚，干咳少痰的中成药是百合固金丸（B对）。百合固金丸：【主治】肺肾阴虚，燥咳少痰，痰中带血，咽干喉痛。川贝止咳露（A错）：【主治】风热咳嗽，痰多上气或燥咳。通宣理肺丸（C错）：【主治】风寒束表、肺气不宣所致的感冒咳嗽，症见发热、恶寒、咳嗽、鼻塞流涕、头痛、无汗、肢体酸痛。苏子降气丸（D错）：【主治】上盛下虚、气逆痰壅所致的咳嗽喘息、胸膈满闷。复方四季青片（E错）的主治，2022年考试指南未明确说明。